关于儿童运动的发展规律说法正确的是
A. 婴儿最初的动作是局部的
B. 儿童正面的动作先于反面的动作
C. 儿童动作的发展是自足端向头端进行
D. 儿童动作发展从肢体远端开始
E. 动作发展是从集中到泛化

正确答案：B。儿童正面的动作先于反面的动作

解析：本题考查儿童运动发育的规律。儿童正面的动作先于反面的动作（B对）。儿童运动发育的规律：1.从泛化到集中（AE错）：婴儿最初的动作是全身性的、不精确的，以后逐步分化为局部的、精确的动作，由不协调到协调；2.从上到下：儿童动作的发展是自头端向足端进行（C错）；3.从近到远（D错）：儿童动作的发展是从身体中部开始，越接近躯干的部位动作发展越早，然后逐渐向肢体远端发展；4.先正后反：即儿童正面的动作先于反面的动作。